抢救左心衰急性肺水肿时，下列措施中错误的是
A. 取下肢下垂坐位
B. 静脉注射毛花苷C
C. 低流量间断给氧
D. 静脉注射呋塞米
E. 安慰患者，稳定情绪

正确答案：C。低流量间断给氧

解析：抢救左心衰急性肺水肿时的给氧方法是高流量鼻管给氧或加压给氧。掌握“心力衰竭”知识点。